下述哪项是早期宫颈癌的症状
A. 阴道大量排液
B. 反复阴道出血
C. 接触性阴道出血
D. 大腿及腰骶部疼痛
E. 恶病质

正确答案：C。接触性阴道出血